小儿肺炎喘嗽的基本病机是
A. 肺气郁闭
B. 心火内炽
C. 痰饮内伏
D. 心阳虚衰
E. 邪犯肺卫

正确答案：A。肺气郁闭

解析：肺炎喘嗽病理机制主要是肺气郁闭之演变，痰热是主要的病理产物（A对）。肺气郁闭，肺主气而朝百脉，郁而生热而致心火内炽，心火内炽为病因（B错）。肺主一身之气化，通调水道，邪气痹阻于肺，水液输化无权，留滞肺络，凝而为痰，痰饮内伏而致咳嗽、气促、喉中痰鸣，痰饮内伏为病因（C错）。心阳虚衰为肺炎喘嗽变证的病机，非肺炎喘嗽病机（D错）。小儿感受外邪，侵犯肺卫即邪犯肺卫致肺气失宣，肺失清肃，出现肺炎喘嗽，故邪犯肺卫为感冒之病机（E错）。